他汀类药物的非调血脂作用包括
A. 改善血管内皮功能
B. 增强血管平滑肌细胞增殖和迁移
C. 稳定和缩小动脉粥样硬化斑块
D. 减轻动脉粥样硬化过程的炎性反应
E. 抗氧化

正确答案：A、C、D。改善血管内皮功能；稳定和缩小动脉粥样硬化斑块；减轻动脉粥样硬化过程的炎性反应

解析：本题考查他汀类药物。他汀类药物除了调血脂作用外，还有调节内皮功能（A对）、抗血小板黏附聚集、抗血栓形成、稳定粥样硬化斑块（C对）、抗氧化、抗炎（D对）、抑制心肌肥厚、促进骨形成和（或）抑制骨吸收等多方面作用。